高血压患者应用抗高血压药+利尿剂属于
A. 超剂量用药
B. 非适应证用药
C. 有目的联合用药
D. 超适应证用药
E. 过度治疗用药

正确答案：C。有目的联合用药

解析：本组题考查联合用药的合理性。高血压患者应用抗高血压药+利尿剂属于有目的联合用药（C对）。利尿剂可增加抗高血压药的降压效果，二者常常联用。普通感冒（上感）由多种病原体（鼻病毒、腺病毒、柯萨奇病毒、冠状病毒、副流感病毒）感染而致，因此复方抗感冒药中含有抗病毒药。普通感冒无严重症状者可以不用或少用药，除并发化脓性扁桃体炎、咽炎、支气管炎和肺炎者在医师指导下使用抗生素外，一般不需要给予抗生素。普通感冒患者应用抗病毒药+抗生素属于无适应证用药（B错）。小檗碱抗菌消炎；鞣酸蛋白可减轻炎症、保护肠道正常，二者单用均可治疗感染性腹泻，联用属于过度治疗用药（E错）。